取全口印模时，制作个别托盘的目的是
A. 便于操作
B. 能获取功能式印模
C. 能获取解剖式印模
D. 不影响下颔运动
E. 能获得咬合平衡

正确答案：B。能获取功能式印模

解析：本题考查制作个别托盘的目的。取全口印模时，制作个别托盘的目的是获取功能式印模（B对）。全口义齿修复中良好的吸附力的获得在于取模的精准，一定要取得精确的印模，反映口腔解剖形态，以使基托与口腔黏膜高度密合，一般用二次印模，制作个别托盘，取标准的功能印模。